在处方适宜性审核时，应特别注意是否有潜在临床意义的相互作用和配伍禁忌。下列药物合用会有不良互相作用的是
A. 阿莫西林和克拉维酸钾
B. 头孢哌酮和舒巴坦
C. 苄丝肼和左旋多巴
D. 甲氧氯普胺和氯丙嗪
E. 亚胺培南和西司他丁钠

正确答案：D。甲氧氯普胺和氯丙嗪

解析：本题考查药物的相互作用。甲氧氯普胺和氯丙嗪合用加重锥体外系反应（D对）。阿莫西林和克拉维酸钾合用（A错）、头孢哌酮和舒巴坦合用（B错）、苄丝肼和左旋多巴合用（C错）、亚胺培南和西司他丁钠合用（E错）均能增加疗效。